治疗支气管哮喘最有效的药物是
A. 沙丁胺醇
B. 布地奈德
C. 色甘酸钠
D. 曲尼司特
E. 氨茶碱

正确答案：B。布地奈德

解析：支气管哮喘的长期规范化治疗可使大多数患者达到良好或完全的临床控制。哮喘的治疗药物分为控制性药物和缓解性药物。治疗支气管哮喘最有效的药物是糖皮质激素（布地奈德）（B对），由于哮喘的病理基础是慢性非特异性炎症，糖皮质激素可通过作用于气道炎症形成的诸多环节，来抑制气道炎症的形成，属于控制性药物。沙丁胺醇（A错）为短效β₂受体激动剂（SABA），属于缓解性药物，是哮喘急性发作的首选药物。色甘酸钠（C错）属于控制性药物，有抗过敏平喘的作用，用于预防哮喘的发作。曲尼司特（D错）属于控制性药物，可作为阿司匹林哮喘、运动性哮喘和伴有过敏性鼻炎哮喘患者的治疗。氨茶碱（E错）是目前治疗哮喘的有效药物之一，用于轻～中度哮喘急性发作及哮喘的维持治疗，短效茶碱属于缓解性药物，缓释茶碱为控制性药物，尤适用于夜间哮喘症状的控制。小剂量缓释茶碱和ICS联合是目前常用的哮喘控制性药物之一。